以下各项牙髓组织形成牙本质功能的叙述中，哪一项不确切
A. 受到某些刺激后牙髓可形成修复性牙本质
B. 继发性牙本质的形成可使髓腔闭锁
C. 牙髓组织在一生中不断形成继发性牙本质
D. 修复性牙本质可阻断外界刺激，保护自身不再受伤害
E. 牙髓坏死后，形成牙本质的功能丧失

正确答案：D。修复性牙本质可阻断外界刺激，保护自身不再受伤害

解析：本题考查牙髓组织形成牙本质的功能。以下各项牙髓组织形成牙本质功能的叙述中不确切的是修复性牙本质可阻断外界刺激，保护自身不再受伤害（D错，为本题正确答案）。关于修复性牙本质可以阻断外界刺激的研究目前仍处于不完善的阶段。在正常情况下，牙髓中的成牙本质细胞在牙的一生中不断形成继发性牙本质（CE对），受到某些刺激后牙髓可形成修复性牙本质（A对），加速牙髓增龄性变化，使髓腔变小，甚至闭塞（B对），修复性牙本质的形成是一种慢性防御机制，不能免受急性损伤。